中脑右侧大脑脚处皮质脊髓束受损，会导致哪一侧肢体瘫痪
A. 右侧下肢瘫痪
B. 右侧上、下肢瘫痪
C. 左侧上肢瘫痪
D. 左侧下肢瘫痪
E. 左侧上、下肢瘫痪

正确答案：E。左侧上、下肢瘫痪

解析：中脑右侧大脑脚处皮质脊髓束向下达锥体后，大部分纤维交叉至对侧支配对侧四肢肌。少部分纤维最后在白质前连合交叉至对侧支配对侧躯干肌和上肢近端肌的运动，或始终不交叉支配同侧躯干肌。因而中脑右侧大脑脚处皮质脊髓束受损使左侧肢体肌失去神经支配，导致左侧上、下肢瘫痪（E对）。